具有促进女子胞发育成熟的物质是
A. 精血
B. 天癸
C. 肾气
D. 肝血
E. 肾阳

正确答案：B。天癸

解析：《素问·上古天真论》“岐伯曰：女子七岁。肾气盛，齿更发长； 二七而天癸至，任脉通，太冲脉盛，月事以时下，故有子；三七…”，女子二七而天癸至，女子胞发育成熟，月事按时而至而能生子（B对）。